男，36岁。心悸、怕热、手颤、乏力一年，大便不成形，3～4次/天，体重下降11公斤。查体：脉搏90次/分，血压128/90mmHg，皮肤潮湿，双手细颤，双眼突出，甲状腺弥漫Ⅱ度肿大，可闻及血管杂音，心率104次/分，律不齐，心音强弱不等，腹平软，肝脾肋下未及，双下肢无水肿。本患治疗首选是
A. 丙硫氧嘧啶
B. 立即行甲状腺大部分切除
C. 核素¹³¹I
D. 心得安
E. 复方碘溶液

正确答案：C。核素¹³¹I

解析：青年男性患者，出现长期心悸怕热，手颤乏力，体重下降，大便次数增多（甲状腺功能亢进症典型症状）。眼球突出，甲状腺肿大并可闻及血管杂音（甲状腺功能亢进典型体征），因此本例考虑诊断为甲状腺功能功能亢进。患者心率104次/分（正常60～100次/分），心律不齐，心音强弱不等，脉搏短绌（心率104次/分＞脉率90次/分），符合房颤的临床表现，提示患者出现甲亢性心脏病，甲亢性心脏病为甲亢的严重并发症，可持续进展，最终导致心力衰竭。因此应对甲亢性心脏病进行根治，首选核素¹³¹I治疗（C对）。丙硫氧嘧啶（A错）通过减少甲状腺激素的产生控制症状，但易复发，根治率较低。本例患者甲亢合并有心脏病，立即施行手术治疗（B错）易发生心脏意外、甲状腺危象等情况，应先控制心脏症状然后再进行手术治疗。心得安（D错）为β受体阻滞剂，主要通过阻断甲状腺激素对心脏的兴奋作用控制甲亢症状，并不能减少甲状腺激素的产生，无法根治甲亢。复方碘溶液（E错）仅用于手术前及甲状腺危象，常规使用会加重和延长甲亢病程，增加复发的可能（P686）。